预防结核病疫苗初种年龄
A. 生后2～3天到2个月之内
B. 2个月以上
C. 9个月以上易感儿
D. 3个月以上小儿
E. 1岁以上

正确答案：A。生后2～3天到2个月之内

解析：本题考查预防结核病疫苗的初种年龄。新生儿对结核病无先天免疫，出生即易感，同时新生儿细胞免疫发育较成熟，故新生儿出生后2～3天到2个月之内（A对BCDE错）即可接种卡介苗，以达到预防结核病的最佳时间。